上述各项中符合急诊科道德要求的是
A. 尊重病人的人格
B. 精诚团结密切协作
C. 分秒必争全力以赴
D. 具有无私奉献精神
E. 保守隐私和秘密

正确答案：C。分秒必争全力以赴

解析：作为急诊科大夫，对于抢救患者我们应当恪守急诊科道德要求，做到分秒必争、全力以赴、常备不懈、沉着冷静、集思广益、团结协作、优化技能、强化功底、人性服务、呵护心理、胆大心细、坚守慎独（C对）。尊重病人的权利和人格为中心的医德的基本原则之一（A错）。医师之间的关系道德要求医师之间应当：1.尊重同道，彼此信任，2.取长补短，互相学习，3.精诚合作，互谅互让，4.求同存异，公平竞争（B错）。由于传染病科的高风险，以及严格的防传染制度，就要求传染科的医师具有无私奉献精神（D错）。尊重原则要求医务人员尊重患者。欧美一般称为自主原则，即对自主的人及其自主性的尊重。知情同意、知情选择、要求保守秘密和隐私等均是尊重患者的体现。广义上的尊重原则还包括医务人员尊重患者及其家属的人格（E错）。